呋塞米的主要不良反应包括
A. 水与电解质紊乱
B. 高血钾症
C. 高尿酸血症
D. 耳毒性
E. 心脏毒性

正确答案：A、C、D。水与电解质紊乱；高尿酸血症；耳毒性

解析：本题考查呋塞米的不良反应。呋塞米的主要不良反应：1.水与电解质紊乱（A对）；2.低钾血症（B错）；3.耳毒性（D对）；4.高尿酸血症（C对）；5.其他：可引起高血糖（但很少导致糖尿病）；升高LDL-C和三酰甘油、降低HDL-C；引起恶心、呕吐，大剂量时尚可出现胃肠出血。少数患者可发生粒细胞及血小板减少。亦可发生过敏反应，表现为皮疹、嗜酸性粒细胞增多，偶有间质性肾炎等，停药后可以迅速恢复，由于呋塞米、布美他尼和托拉塞米都有磺胺基团，对磺胺过敏者使用这三个药物可能会发生交叉过敏反应。